直肠盆部肠腔内，有半月形的直肠横襞，其中最大而明显的中横襞
A. 恒定位于直肠前左侧壁，距肛门5cm
B. 恒定位于直肠前右侧壁，距肛门5cm
C. 恒定位于直肠右侧壁，距肛门7cm
D. 恒定位于直肠后左侧壁，距肛门5cm
E. 恒定位于直肠后左侧壁，距肛门7cm

正确答案：C。恒定位于直肠右侧壁，距肛门7cm

解析：最大和明显的横襞为中横襞，位置恒定于直肠右前壁(ADE错)，距肛门7cm(B错C对)。